女性，35岁。患风湿性瓣膜病二尖瓣狭窄及关闭不全，因慢性心力衰竭，每日服用地高辛0.125mg，1天前突然气促，水肿症状加重，心率120次/分，心律绝对不规则，首选的治疗是
A. 静脉注射毛花苷丙
B. 静脉注射呋塞米
C. 直流电同步电复律
D. 静脉滴注氨利酮
E. 皮下或静脉滴注阿托品

正确答案：A。静脉注射毛花苷丙

解析：患者中年女性，患风湿性瓣膜病二尖瓣狭窄及关闭不全，有慢性心力衰竭史，1天前突然气促，水肿症状加重，考虑慢性心力衰竭急性加重，心率120次/分，心律绝对不规则，结合病史，考虑心房颤动，故患者诊断为慢性心力衰竭急性加重伴快速心房颤动。伴有快速心房颤动的收缩性心衰是应用洋地黄的最佳指征。对于液体潴留等心衰症状急性加重的患者，首选的治疗是静脉注射毛花苷丙（A对），快速增强心肌收缩力，缓解肺水肿，待病情稳定后再应用地高辛作为长期治疗策略之一。呋塞米（B错）除利尿作用外，还通过扩张静脉而缓解肺水肿，常用于急性心力衰竭的治疗，但不是本题的最佳答案。在使用洋地黄时，一般禁用电复律（C错），因为易导致室颤。氨利酮（氨力农）（D错）为磷酸二酯酶抑制剂，主要通过抑制磷酸二酯酶活性促进Ca²⁺通道膜蛋白磷酸化，Ca²⁺内流增加，从而增强心肌收缩力，仅适用于心脏术后急性收缩性心力衰竭、难治性心力衰竭及心脏移植前的终末期心力衰竭的患者短期使用（P176）。阿托品（E错）常用于有传导阻滞及缓慢性心律失常者。